化妆品痤疮主要是由化妆品中含有的
A. 香精引起的
B. 可溶性色素引起的
C. 防腐剂引起的
D. 表面活性剂引起的
E. 矿物油制成的基质引起的

正确答案：E。矿物油制成的基质引起的

解析：本题考查化妆品痤疮的引起原因。化妆品痤疮是由化妆品引起的面部痤疮样皮疹，是仅次于接触性皮炎的常见化妆品皮肤病。主要是由化妆品中含有的矿物油制成的基质引起的（E对ABCD错）。